有抑制骨髓造血功能的药物
A. 羟氨苄青霉素
B. 氯霉素
C. 头孢他啶
D. 克拉维酸
E. 红霉素

正确答案：B。氯霉素

解析：本题考查氯霉素。氯霉素（B对）典型不良反应为骨髓造血功能抑制，表现为再生性障碍性贫血。羟氨苄青霉素（A错）主要作用于对青霉素敏感的革兰阳性菌以及部分革兰阴性杆菌，对绿脓杆菌无效。头孢他啶（C错）用于严重感染。克拉维酸（D错）为β-内酰胺酶抑制剂，可保护不耐酶的抗菌药物结构免受破坏。红霉素（E错）用于治疗青霉素过敏患者的替代用药、军团菌病、肺炎支原体肺炎等。